计算存在死亡危险，等于
A. 预期死亡概率×组合危险分数
B. 平均死亡概率×危险降低年龄
C. 平均死亡概率×组合危险分数
D. 平均死亡概率×危险分数
E. 预期死亡概率×危险降低程度

正确答案：C。平均死亡概率×组合危险分数